对于艾滋病抗病毒治疗错误的是
A. 目前主张联合治疗
B. 联合用药治疗能延缓AIDS发病和延长患者的生命
C. 代表药物有核苷类反转录酶抑制剂，如奈韦拉平
D. 联合治疗的疗程是HIVRNA达到检测水平以下后，继而用两种药物，持续终生治疗
E. 蛋白酶抑制剂主要包括沙奎那韦、英地那韦、奈非那韦和利托那韦

正确答案：C。代表药物有核苷类反转录酶抑制剂，如奈韦拉平

解析：目前有四类抗HIV药物，分别为核苷类反转录酶抑制剂，如齐多夫定；非核苷类反转录酶抑制剂，如奈韦拉平，因此，代表药物有核苷类反转录酶抑制剂，如奈韦拉平（C错，为本题正确答案）错误；艾滋病作为一种复杂的慢性传染病，目前尚无理想的治疗方法。其治疗原则强调综合治疗，目前主张联合治疗（A对）；高效抗反转录病毒治疗即联合用药可以减少病毒载量，获得免疫功能重建和维持免疫功能，减少药物毒副作用，防止耐药，所以联合用药治疗能延缓AIDS发病和延长患者的生命（B对），提高生活质量；联合治疗的疗程是RNA达到检测水平以下后，继而用两种药物，持续终生治疗（D对），以抑制HIV从潜伏感染的细胞中复制和维持症状的持续缓解；蛋白酶抑制剂：抑制蛋白酶，阻断HIV复制和成熟过程中必须的蛋白质合成。主要药物有沙奎那韦、英地那韦、奈非那韦和利托那韦等（E对）。